28岁已婚妇女，停经50日突觉右下腹剧痛伴休克，面色苍白。为确诊最简便、有效的辅助诊断方法是
A. 尿妊娠试验
B. B超检查
C. 腹腔镜检查
D. 阴道后穹隆穿刺
E. 宫腔镜检查

正确答案：D。阴道后穹隆穿刺

解析：根据题干症状停经后有剧烈腹痛和贫血症状考虑为异位妊娠，已有内出血建议做阴道后穹窿穿刺。掌握“异位妊娠”知识点。